以下均以接种乙肝疫苗为主要防治措施的是
A. 甲型肝炎和乙型肝炎
B. 乙型肝炎和丙型肝炎
C. 丙型肝炎和戊型肝炎
D. 乙型肝炎和丁型肝炎
E. 乙型肝炎和戊型肝炎

正确答案：D。乙型肝炎和丁型肝炎